某女，28岁。皮肤出现红色风团，灼热剧痒，遇热加剧，得冷则减，伴有发热，恶寒，咽喉肿痛，舌红，苔薄白，脉浮数。中医诊断为瘾疹，证属风热犯表，治以消风散加减，开具的处方为：荆芥9g，防风9g，当归6g，地黄12g，苦参6g，蝉蜕6g，牛蒡子9g，知母10g，石膏（捣碎、先煎）30g。该处方中的知母，调配时应付
A. 醋炙品
B. 清炒品
C. 生品
D. 盐炙品
E. 蜜炙品

正确答案：D。盐炙品

解析：本题考查的是饮片的处方应付。该处方中的知母，调配时应付盐炙品（D对）。常见的处方应付实例：（1）处方直接写药名（或炒），需调配清炒品（B错），如紫苏子、莱菔子、谷芽、麦芽、王不留行、酸枣仁、蔓荆子、苍耳子、牛蒡子、白芥子等。（2）处方直接写药名（或炒），需调配麸炒品，如僵蚕、白术、枳壳等。（3）处方直接写药名（或制），需调配炮制品，如草乌（水制）、川乌（水制）、天南星（矾制）、附子（炮制）、吴茱萸（甘草水制）、远志（甘草水制去心）、厚朴（姜制）、何首乌等。（4）处方直接写药名（或炒或炙），需调配烫制品，如龟甲、鳖甲、穿山甲等。（5）处方直接写药名（或煅），需调配煅制品，如花蕊石、钟乳石、自然铜、金礞石、青礞石、瓦楞子等。（6）处方直接写药名（或炒或炭），需调配炭制品，如干漆、炮姜、地榆、侧柏叶、蒲黄等。（7）处方直接写药名（或炒或炙），需调配蜜炙品（E错），如枇杷叶、马兜铃等。（8）处方直接写药名（或炒或炙），需调配醋炙品（A错），如延胡索等。（9）处方直接写药名（或炒或炙），需调配盐炙品，如补骨脂、益智仁等。